患者血浆PaCO₂降低，血浆HCO₃⁻升高，表示有可能
A. 混合型酸碱平衡紊乱
B. 代谢性碱中毒
C. 呼吸性碱中毒
D. 呼吸性酸中毒
E. 代谢性酸中毒

正确答案：A。混合型酸碱平衡紊乱

解析：发生单纯型酸碱平衡紊乱（BCDE错）时PaCO₂和HCO₃⁻变化方向相同，PaCO₂与HCO₃⁻变化方向相反者说明该患者发生酸碱一致型混合型酸碱平衡紊乱（A对）。